能固精止遗的药是
A. 神曲
B. 贯众
C. 莱菔子
D. 鸡内金
E. 苦楝皮

正确答案：D。鸡内金

解析：本题考查的是鸡内金的功效。能固精止遗的药是鸡内金（D对）。鸡内金：【功效】运脾消食，固精止遗，化坚消石。神曲（A错）：【功效】消食和胃。贯众（B错）：【功效】杀虫，清热解毒，止血。莱菔子（C错）：【功效】消食除胀，降气化痰。苦楝皮（E错）：【功效】杀虫，疗癣。